既开窍宁神，又化湿和胃的药是
A. 朱砂
B. 琥珀
C. 石菖蒲
D. 苏合香
E. 安息香

正确答案：C。石菖蒲

解析：本题考查的是石菖蒲的功效。既开窍宁神，又化湿和胃的药是石菖蒲（C对）。石菖蒲：【功效】开窍宁神，化湿和胃。朱砂（A错）：【功效】镇心安神，清热解毒。琥珀（B错）：【功效】安神定惊，活血散瘀，利尿通淋。苏合香（D错）：【功效】开窍辟秽，止痛。安息香（E错）：【功效】开窍辟秽，行气活血，止痛。